男，25岁，过量饮酒后，被同桌酒友送到医院，酒友在未支付医疗费的情况下，匆忙离开医院，医院无法联系到患者的家人。此时，患者血压下降，面色苍白，皮肤湿冷，瞳孔散大。经首诊医师初步判断，为急性酒精中毒，经全力抢救后，患者转危为安。关于实施抢救说法，正确的是
A. 再到当地公安局备案后
B. 在经过主任医师同意后
C. 在医院授权的负责人批准后
D. 联系到患者家属后
E. 找到酒友后

正确答案：C。在医院授权的负责人批准后

解析：《中华人民共和国民法典》第一千二百二十条：“因抢救生命垂危的患者等紧急情况，不能取得患者或者其近亲属意见的，经医疗机构负责人或者授权的负责人批准（C对），可以立即实施相应的医疗措施。”